治疗血虚，常配伍补气药，其根据是
A. 气能生血
B. 气能摄血
C. 气能行血
D. 血能载气
E. 血能生气

正确答案：A。气能生血

解析：气能参与、促进血液的化生。血液的化生以营气、津液和肾精作为物质基础，在这些物质本身的生成以及转化为血液的过程中，每一个环节都离不开相应脏腑之气的推动和激发作用，这是血液生成的动力。气能生血还包含了营气在血液生成中的作用，营气与津液入脉化血，使血量充足。因此，气充盛则化生血液的功能增强。（A对）。气能摄血（B错），是指气发挥统摄作用使血行脉中而不致逸出脉外，从而保证了血液的正常运行及其濡养功能的发挥。气能行血（C错），是指血液的运行有赖于心气、肺气的推动及肝气的疏泄调畅。血能载气（D错），是指气存于血中，依附于血而不致散失，赖血之运载而运行全身。血能生气（E错），是指气的充盛及其功能发挥离不开血液的濡养。在人体各个部位中，血不断地为气的生成和功能活动提供营养，故血足则气旺。